长期应用糖皮质激素后，突然停药所产生的反跳现象是由于病人
A. 对糖皮质激素产生耐药性
B. 对糖皮质激素产生了依赖或病情未能完全控制
C. 肾上腺皮质功能亢进
D. 肾上腺皮质功能减退
E. ACTH分泌减少

正确答案：B。对糖皮质激素产生了依赖或病情未能完全控制